根据《放射诊疗管理规定》，非特殊需要，不得对受孕一定时间段的育龄妇女进行下腹部放射影像检查。该时间段是
A. 受孕后28～34周
B. 受孕后34～36周
C. 受孕后8～15周
D. 受孕后36～38周
E. 受孕后16～28周

正确答案：C。受孕后8～15周

解析：对孕龄妇女腹部或骨盆进行核素显像检查和X射线检查前，应问明是否怀孕。非特殊需要，对受孕后8～15周的孕龄妇女，不得进行下腹部放射影像检查（C对）。